出现反常性酸性尿现象的见于
A. 大量使用噻嗪类利尿剂
B. 呕吐
C. 缺钾
D. 肾上腺皮质激素过多
E. 大量输入含柠檬酸盐抗凝的库存血

正确答案：C。缺钾

解析：出现反常性酸性尿现象的见于缺钾（C对）。